针对单纯严重乙醇中毒同时出现烦躁不安症状的患者，下列救治措施，错误的是
A. 静脉注射50%葡萄糖注射液100ml和胰岛素20U
B. 肌内注射维生素B₁，维生素B₆和烟酸各100mg
C. 静脉滴注维生素C注射液1g
D. 静脉注射纳洛酮0.4mg和吗啡20mg
E. 静脉滴注美他多辛0.9g

正确答案：D。静脉注射纳洛酮0.4mg和吗啡20mg

解析：本题考查乙醇中毒解救。针对单纯严重乙醇中毒同时出现烦躁不安症状的患者，下列救治措施，错误的是静脉注射纳洛酮0.4mg和吗啡20mg（D错，为本题正确答案）。严重者，静脉注射50%葡萄糖注射液100ml与胰岛素20U（A对）；同时肌内注射维生素B₁、维生素B₆及烟酸各100mg（B对）, 以加速乙醇在体内氧化，促进清醒。以后根据病情，可每6～8h重复注射1次。适当补充维生素C（C对）有利于酒精氧化代谢。美他多辛是乙醛脱氢酶激活剂，并能拮抗急、慢性酒精中毒所引起的乙醇脱氢酶活性下降；加速乙醇及其代谢产物乙醛和酮体经尿液排泄，属于促乙醇代谢药。每次0.9g静脉滴注给药（E对）。